急救止血时不够彻底，而且容易增加感染机会的方法是
A. 指压法
B. 加压动脉包扎
C. 填塞法
D. 止血带法
E. 切排法

正确答案：C。填塞法

解析：填塞法：用于肌肉、骨端等渗血。先用1～2层大的无菌纱布铺盖伤口，以纱布条或绷带充填其中，再加压包扎。此法止血不够彻底，且可能增加感染机会。掌握“创伤和战伤”知识点。